研究对象和研究实施人员都不了解试验分组情况，而是由研究设计者来安排和控制全部试验的是
A. 非盲试验
B. 双盲
C. 三盲
D. 单盲
E. 开放性试验

正确答案：B。双盲

解析：本题考查实验流行病学盲法的应用。研究对象和研究实施人员都不了解试验分组情况，而是由研究设计者来安排和控制全部试验的是双盲（B对ACDE错）。